其防疫站调查某市中学生吸烟情况，应采用哪种抽样方法
A. 简单随机抽样
B. 系统抽样
C. 整群抽样
D. 分层抽样
E. 以上均否

正确答案：D。分层抽样

解析：本题考查分层抽样的概念。分层抽样（D对ABCE错）是指先将总体按某种特征分为若干次级总体（层），然后再从每一层内进行单纯随机抽样，组成一个样本的抽样方法。分层抽样比单纯随机抽样所得到的结果精确度更高，组织管理更方便，而且它能保证总体中每一层都有个体被抽到。题中对于市区中学生吸烟情况的调查，适合选取分层抽样的研究方法。